男性，40岁。患风湿性心脏瓣膜病多年。现症见心悸气短，神疲乏力，咳嗽喘促，颧颊暗红，唇甲发绀，舌有瘀斑，脉细结代。其治法是
A. 温补心阳
B. 滋阴安神
C. 温阳利水
D. 泻肺利水
E. 益气活血

正确答案：E。益气活血

解析：青年男性患者，患风湿性心脏瓣膜病多年，症见心悸气短，神疲乏力，咳嗽喘促，颧颊暗红，唇甲发绀，舌有瘀斑，脉细结代。根据患者舌脉证分析，此患者为风心病之气虚血瘀证，治法为益气活血（E对）。温补心阳为心阳虚证的治法（A错）。滋阴养神为心阴不足证的治法（B错），温阳利水为水饮凌心证的治法（C错）。泻肺利水为饮停心肺证的治法（D错）。